基底细胞腺瘤由基底细胞样肿瘤细胞构成，缺乏多形性腺瘤中的哪种成分
A. 腺上皮
B. 肌上皮
C. 基底样细胞
D. 膜性结构
E. 黏液软骨样

正确答案：E。黏液软骨样

解析：基底细胞腺瘤由基底细胞样肿瘤细胞构成，缺乏多形性腺瘤中的黏液软骨样成分。其他成分均存在。掌握“基底细胞腺瘤及恶性多形性腺瘤”知识点。